正常足月新生儿，身长前半年平均每月增长
A. 1.0cm
B. 1.5cm
C. 2.0cm
D. 2.5cm
E. 3.0cm

正确答案：D。2.5cm

解析：正常足月新生儿出生时身长约50cm，前半年平均每月增长2.5cm，后半年平均每月增长1.5cm，第1年身长约增长25cm，第2年约增长10cm～12cm。掌握“体格生长常用指标”知识点。